与外感咳嗽关系最密切的病因是
A. 热
B. 风
C. 寒
D. 暑
E. 湿

正确答案：B。风

解析：外感咳嗽即六淫为邪，在肺卫功能减弱或失调的情况下，乘虚从口鼻而入，或从皮毛侵袭，伤及肺系，使肺气不清，肺失宣降，气机上逆所致。《河间六书·咳嗽论》说：“寒、暑、燥、湿、风、火六气，皆令人咳嗽”即是此意。但由于四时主气的不同，因而人体所感受的致病外邪亦有区别，其中以风、寒、热、燥关系密切，又常以风为先导（B对），故临床以风寒、风热、燥邪咳嗽较为多见。